根据《药品管理法》，对未取得《药品生产许可证》生产、销售药品的情形，药品监管理部门对其责令关闭，没收违法生产、销售的药品和违法所得，并处罚款。药品监督管理部门作出的该行为属于
A. 行政裁决
B. 行政处分
C. 行政处罚
D. 行政强制

正确答案：C。行政处罚

解析：本题考查的是行政处罚的种类。根据《药品管理法》，对未取得药品生产许可证生产、销售药品的情形药品监管理部门对其责令关闭，没收违法生产销售的药品和违法所得，并处罚款。药品监督管理部门作出的该行为属于行政处罚（C对）。药品行政处罚中的没收内容包括没收非法财物（药品、假药、劣药）、没收违法所得、没收与违法行为有关的其他财物等。行政裁决（A错）是指行政主体依照法律授权和法定程序，对当事人之间发生的与行政管理活动密切相关的、与合同无关的特定民事、经济纠纷进行裁决的具体行政行为。行政处分（B错）是指国家行政机关依照行政隶属关系给予有违法失职行为的国家机关公务人员的一种惩罚措施，包括警告、记过、记大过、降级、撤职、开除。行政强制（D错），是指行政机关为了实现预防或制止正在发生或可能发生的违法行为、危险状态以及不利后果，或者为了保全证据、确保案件查处工作的顺利进行等行政目的，而对相对人的人身或财产采取强制性措施的行为，包括行政强制措施和行政强制执行。行政强制措施的种类包括：①限制公民人身自由；②查封场所、设施或者财物；③扣押财物；④冻结存款、汇款；⑤其他行政强制措施。行政强制执行的方式包括：①加处罚款或者滞纳金；②划拨存款、汇款；③拍卖或者依法处理查封、扣押的场所、设施或者财物；④排除妨碍、恢复原状；⑤代履行；⑥其他强制执行方式。